中药的酸水提取液碱化后用氯仿萃取，氯仿层再用酸水萃取，酸水层加碘-碘化钾试剂，能生成红棕色沉淀的是
A. 香豆素
B. 黄酮
C. 生物碱
D. 木脂素
E. 蒽醌

正确答案：C。生物碱

解析：本题考查的是常用的生物碱沉淀试剂。中药的酸水提取液碱化后用氯仿萃取，氯仿层再用酸水萃取，酸水层加碘-碘化钾试剂，能生成红棕色沉淀的是生物碱（C对）。大多数生物碱在酸水或稀醇中与某些试剂反应生成难溶于水的络合物或复盐，这一反应称为生物碱沉淀反应，这些试剂称为生物碱沉淀试剂。常用的生物碱沉淀试剂有碘化铋钾试剂、碘化汞钾试剂、碘-碘化钾试剂、硅钨酸试剂、饱和苦味酸试剂、雷氏铵盐试剂等。其中碘-碘化钾试剂与生物碱反应生成红棕色无定形沉淀。香豆素类（A错）的显色反应：（1）异羟肟酸铁反应；（2）三氯化铁反应；（3）Gibb's反应；（4）Emerson反应。黄酮类（B错）的显色反应：黄酮类化合物的显色反应多与分子中的酚羟基及γ-吡喃酮环有关。1.还原试验：（1）盐酸-镁粉（或锌粉）反应；（2）四氢硼钠（钾）反应；2.金属盐类试剂的络合反应：（1）铝盐；（2）铅盐；（3）锆盐；（4）镁盐；（5）氯化锶；（6）三氯化铁；3.硼酸显色反应；4.碱性试剂显色反应。木脂素类（D错）分子中常用的官能团为醇羟基、酚羟基、甲氧基、亚甲二氧基、羧基和内酯环，因此它也具有这些官能团所具有的化学性质。如Labat反应等。蒽醌类（E错）属于醌类化合物。醌类化合物的显色反应：1.Feigl反应；2.无色亚甲蓝显色试验；3.Bornträger's反应；4.Kesting-Craven反应；5.与金属离子的反应。